肝脏左纵沟的后半部内有
A. 胆囊
B. 静脉韧带
C. 下腔静脉
D. 肝圆韧带
E. 肝镰状韧带

正确答案：B。静脉韧带

解析：胆囊(A错)位于右侧纵沟前部，静脉韧带(B对)位于左纵沟后部，下腔静脉(C错)位于右侧纵沟后部，肝圆韧带(D错)位于左侧纵沟前部，肝镰状韧带(E错)位于肝膈面。